关于毛细淋巴管，何者为错
A. 起于组织间隙内
B. 管腔粗细一致、均匀
C. 常与毛细血管伴行
D. 管壁由单层内皮细胞构成
E. 管壁通透性大于毛细血管

正确答案：B。管腔粗细一致、均匀

解析：毛细淋巴管起于组织间隙内（A对）。管腔粗细不一（B错，为本题正确答案）。常与毛细血管伴行（C对）。管壁由单层内皮细胞构成（D对）。毛细淋巴管的通透性比毛细血管较大（E对）。